为解救苯巴比妥中毒的患者，在10%葡萄糖注射液中应该加入一些
A. 氯化铵注射液
B. 氯化钙注射液
C. 抗坏血酸注射液
D. 碳酸氢钠注射液
E. 维生素B₆注射液

正确答案：D。碳酸氢钠注射液

解析：本题考查巴比妥类镇静催眠药中毒解救。为解救苯巴比妥中毒的患者，在10%葡萄糖注射液中应该加入一些碳酸氢钠注射液（D对）。巴比妥类药物中毒静脉输液并加入碳酸氢钠或乳酸钠，以碱化尿液，加速药物的排泄。同时给予利尿药加快药物的排出。